目前常用的橡胶类印模材料主要为
A. 硅橡胶和寒天
B. 硅橡胶和聚酸橡胶
C. 硅橡胶和乙醚橡胶
D. 硅橡胶和聚醚橡胶
E. 硅橡胶和聚醚胺橡胶

正确答案：D。硅橡胶和聚醚橡胶

解析：聚醚橡胶和加成型硅橡胶印模材都有专用于单一印模法的“中流动性印模材”（简称中体），多用自动调和机调和。掌握“暂时冠及印模与模型”知识点。